全口义齿取初印模使用印模膏，将其软化的热水温度为
A. 40～50℃
B. 50～60℃
C. 60～70℃
D. 70～80℃
E. 80℃以上

正确答案：C。60～70℃

解析：取初印模：初印模可用成品无牙颌托盘加藻酸盐印模材制取，或用成品无牙颌托盘加印模膏制取。用印模膏时，需先将其放置在60～70℃热水中软化。掌握“无牙颌的印模与模型”知识点。